特纳牙是由于
A. 小儿患水痘或猩红热所引起
B. 小儿患严重的消化不良所引起
C. 小儿乳牙根尖周严重感染影响继承恒牙所引起
D. 孕妇患风疹或毒血症
E. 甲状旁腺功能降低引起

正确答案：C。小儿乳牙根尖周严重感染影响继承恒牙所引起

解析：本题考查特纳牙。特纳牙是由于小儿乳牙根尖周严重感染影响继承恒牙所引起（C对）。特纳牙不同于其他牙釉质发育不全累及口内多数牙，其往往只涉及单颗牙齿。若患牙为尖牙或前磨牙，通常是因乳牙感染较重，影响了后继恒牙的发育；若为前牙，则多由于创伤因素所致，受创乳牙被推入下方发育中的恒牙胚，从而扰乱了恒牙牙釉质的发育。小儿患水痘或猩红热（A错）、严重的消化不良（B错）、孕妇患风疹或毒血症（D错）、甲状旁腺功能降低（E错）可导致釉质发育不全。